口腔的后界为
A. 腭垂
B. 舌腭弓
C. 咽腭弓
D. 咽门
E. 舌根

正确答案：D。咽门

解析：本题考查口腔境界及唇、颊的局部解剖。口腔的境界：前界为上下唇，后界为咽门（D对），两侧为颊，上界为腭，下以舌下区为界。由上下牙列、牙龈和牙槽骨弓将口腔分为两部分，牙列的唇颊侧部分称为口腔前庭。牙列的舌侧部分称为固有口腔。